低渗性脱水时尿钠减少的主要原因是
A. 交感—肾上腺髓质系统兴奋
B. 肾素－血管紧张素－醛固酮系统兴奋
C. 交感－肾上腺髓质系统抑制
D. 肾素－血管紧张素－醛固酮系统抑制
E. 无

正确答案：B。肾素－血管紧张素－醛固酮系统兴奋

解析：低渗性脱水的主要特点是细胞外液量减少，血容量降低可激活肾素-血管紧张素-醛固酮系统（B对）使醛固酮分泌增多，醛固酮具有保钠保水排钾的生理作用，使肾小管对钠的重吸收增加，尿钠减少。